影响筛检试验的阳性预测值的主要因素是
A. 灵敏度
B. 特异度
C. 现患率
D. 受检人数
E. 重复性

正确答案：C。现患率